HIV的感染途径不包括
A. 输血制品
B. 呼吸道传播
C. 母婴传播
D. 不洁注射
E. 性接触传播

正确答案：B。呼吸道传播

解析：人类免疫缺陷病毒（HIV）目前公认的传播途径主要是性接触传播（E对）、血液接触（不洁注射、输血制品等）（AD对）和母婴传播（C对），以及接受HIV感染者的器官移植；呼吸道传播（B错，为本题正确选项）不是HIV的感染途径。